依地酸钠用于解救
A. 水银中毒
B. 有机磷中毒
C. 硫酸铜中毒
D. 氰化物中毒
E. 吗啡中毒

正确答案：C。硫酸铜中毒